病毒的灭活疫苗包括
A. 脊髓灰质炎灭活疫苗
B. 狂犬病灭活提纯疫苗
C. 森林脑炎灭活疫苗
D. 乙型脑炎灭活疫苗
E. 以上均正确

正确答案：E。以上均正确

解析：病毒的灭活疫苗：主要有脊髓灰质炎灭活疫苗（或称Salk疫苗）、乙型脑炎灭活疫苗、人用狂犬病灭活提纯疫苗。肾综合征出血热灭活疫苗、森林脑炎灭活疫苗、甲型肝炎灭活疫苗等。掌握“病毒感染检查方法及防治原则”知识点。